某县历年麻疹发病率均在5/10万～8/10万之间，去年该县麻疹发病率为7.5/10万，判断其流行强度为
A. 散发
B. 暴发
C. 流行
D. 大流行
E. 地方性

正确答案：A。散发

解析：本题考查疾病流行强度。疾病流行强度常用散发、暴发、流行及大流行表示。其中散发（A对BCDE错）指发病率呈历年的一般水平，各病例间在发病时间和地点上无明显联系，表现为散在发生。